妊娠大概25周的患者，1型糖尿病，未检测血糖。现恶心呕吐昏迷，ph7.18，二氧化碳分压20mmHg，导致患者酸中毒的原因
A. 尿酸增加
B. 乳酸增加
C. 丙酮酸增加
D. 酮体增加
E. 转氨酶增加

正确答案：D。酮体增加

解析：1型糖尿病孕妇易发生糖尿病酮症酸中毒（D对）。